羟甲戊二酰辅酶A还原酶抑制剂（他汀类）与贝丁酸类调节血脂药联合应用时，可能引起死亡严重不良反应的是
A. 输尿管结石
B. 十二指肠溃疡
C. 急性心肌梗死
D. 横纹肌溶解
E. 糖尿病性坏疽

正确答案：D。横纹肌溶解

解析：本题考查药物的联合应用。羟甲戊二酰辅酶A还原酶抑制剂（他汀类）与贝丁酸类调节血脂药联合应用时，可能引起死亡严重不良反应的是横纹肌溶解（D对）。他汀类药物可导致横纹肌溶解，与贝特类药物联用时，肌肉毒性表现为协同作用，加大横纹肌溶解的不良反应。